常与沟纹舌并存的疾病是
A. 地图舌
B. 叶状乳头炎
C. 贫血性舌炎
D. 丝状乳头炎
E. 毛舌

正确答案：A。地图舌

解析：沟纹舌表现为舌背一条或长或短的中心深沟和多条不规则的副沟。因沟纹的形状或排列方向不同，又称脑回舌或者褶皱舌，且多伴有地图舌的表现。掌握“地图舌、沟纹舌及舌乳头炎”知识点。